性温，能疏肝理气化痰的药是
A. 枳实
B. 佛手
C. 香附
D. 薄荷
E. 乌药

正确答案：B。佛手

解析：本题考查的是佛手的性味归经与功效。性温，能疏肝理气化痰的药是佛手（B对）。佛手：【性味归经】辛、苦，温。归肝、脾、胃、肺经。【功效】疏肝理气，和中，化痰。枳实（A错）：【性味归经】苦、辛，微寒。归脾、胃、大肠经。【功效】破气消积，化痰除痞。香附（C错）：【性味归经】辛、微苦、微甘，平。归肝、三焦经。【功效】疏肝理气，调经止痛。薄荷（D错）：【性味归经】辛，凉。归肺、肝经。【功效】宣散风热，清利头目，利咽，透疹，疏肝。乌药（E错）：【性味归经】辛，温。归肺、脾、肾、膀胱经。【功效】行气止痛，温肾散寒。